某男，42岁。自诉咽中如有物阻，呕吐不出，吞咽不下，胸胁满闷，化痰降硬，处以半夏厚朴；其药物构成为姜半夏、茯苓、厚朴、生姜、紫苏叶。处方中厚朴主要化学成分厚朴酚，其结构类型是
A. 黄酮
B. 香豆素
C. 木脂素
D. 生物碱
E. 三萜皂苷

正确答案：C。木脂素

解析：本题考查的是厚朴的主要化学成分类型。处方中厚朴主要化学成分厚朴酚，其结构类型是木脂素（C对）。厚朴中主要化学成分为木脂素类化合物，包括厚朴酚以及和厚朴酚等，《中国药典》采用高效液相色谱法测定药材中厚朴酚与和厚朴酚含量，两者总含量不得少于2.0%。黄酮（A错）类化合物广泛存在于自然界中，多存在于高等植物及羊齿类植物中。苔类中含有的黄酮类化合物为数不多，而藻类、霉菌、细菌中没有发现黄酮类化合物。含黄酮类化合物的中药有黄芩、葛根、银杏叶、槐花、陈皮、满山红等。香豆素（B错）是邻羟基桂皮酸的内酯，广泛分布于高等植物中，尤其以芸香科和伞形科为多见，少数发现于动物和微生物中。含香豆素的常用中药有秦皮、前胡、肿节风、补骨脂等。生物碱（D错）类主要分布于植物界，在动物界中少有发现。生物碱绝大多数存在于双子叶植物中，已知有50多个科的120多个属中存在生物碱。与中药有关的典型的科有毛茛科（黄连属黄连，乌头属乌头、附子）、防己科（汉防己、北豆根）、罂粟科（罂粟、延胡索）、茄科（曼陀罗属洋金花、颠茄属颠茄、莨菪属莨菪）、马钱科（马钱子）、小檗科（三颗针）、豆科（苦参属苦参、槐属苦豆子）等。单子叶植物也有少数科属存在生物碱，如石蒜科、百合科（贝母属的川贝母、浙贝母）、兰科等。少数裸子植物如麻黄科、红豆杉科、三尖杉科和松柏科也存在生物碱。低等植物中仅发现极个别的存在生物碱，如烟碱存在于蕨类植物中，麦角生物碱存在于菌类植物中。地衣、苔藓类植物中仅发现少数简单的吲哚类生物碱。藻类、水生类植物中未发现生物碱。三萜皂苷（E错）：三萜类：多数三萜类化合物是一类基本母核由30个碳原子组成的萜类化合物，其结构根据异戊二烯定则可视为六个异戊二烯单位聚合而成，也是一类重要的中药化学成分。皂苷是一类结构复杂的苷类化合物，其苷元为具有螺甾烷及其有相似生源的甾族化合物或三萜类化合物。大多数皂苷水溶液用力振荡可产生持久性的泡沫。故称为皂苷。皂苷在自然界中分布很广，约有一半植物中含有皂苷，其中以薯蓣科、百合科、毛茛科、五加科、伞形科和豆科等分布最为广泛。近年来，从一些海洋生物中如海参、海星等，亦分离得到了皂苷类化合物。含三萜类化合物的中药有人参、三七、甘草、黄芪、合欢皮、商陆、柴胡等。